患者，男，患急性子痈2天，恶寒发热，左侧睾丸肿大疼痛，疼痛引及子系（精索），伴有发热，恶寒，舌红苔黄腻，脉滑数。证属湿热下注，气血壅滞，经络阻隔为患。治宜清泻肝经湿热，应首选方剂
A. 透脓散
B. 龙胆泻肝汤
C. 萆薢化毒汤萆薢
D. 滋阴除湿汤
E. 橘核汤加减

正确答案：B。龙胆泻肝汤

解析：患急性子痈2天，湿热随肝经下注，故见左侧睾丸肿大疼痛，疼痛引及子系（精索）；湿热郁于肌表故见发热，恶寒；舌红苔黄腻，脉滑数均为湿热下注的特点；治宜清泻肝经湿热，龙胆泻肝汤可以清利肝胆湿热，可以作为首选方剂（B对）。透脓散（A错）补益气血，托毒透脓，驱邪中兼扶正，并能去腐生新，治疗痈疽诸毒，内脓已成，不穿破者。萆薢化毒汤（C错）用于治疗湿热痈疡，气血实者。滋阴除湿汤（D错）可以滋阴养血，除湿润燥，治疗慢性湿疹、亚急性湿疹、脂溢性皮炎。橘核汤（E错）用于治疗水疝。